妇女妊娠40周，正常的羊水量为
A. 300ml
B. 400ml
C. 800ml
D. 1000ml
E. 1200ml

正确答案：C。800ml

解析：正常羊水量：母儿间的液体交换，主要通过胎盘，每小时约3600ml。母体与羊水的交换，主要通过胎膜，每小时约400ml，以保持羊水量相对恒定。正常羊水量：①妊娠8周：5～10ml；②妊娠10周：约30ml；③妊娠20周：约400ml；④妊娠38周：约1000ml；⑤妊娠40周：约800ml；⑥过期妊娠羊水量明显减少至300ml以下。掌握“妊娠生理”知识点。